用酒精给高热患者擦浴的散热方式属于
A. 辐射散热
B. 对流散热
C. 传导散热
D. 蒸发散热
E. 传导和蒸发散热

正确答案：D。蒸发散热